患者腹痛高热，体查：腹部压痛，反跳痛，肠鸣音消失，CT示：腹部积液，积液，腹腔穿刺，抽出黄绿色液体，请问致病菌
A. 肺炎克雷伯
B. 大肠埃希菌
C. 变形杆菌
D. 铜绿假单胞菌
E. 肠球菌

正确答案：B。大肠埃希菌

解析：患者腹痛高热，体查：腹部压痛，反跳痛，肠鸣音消失，CT示：腹部积液，积液，腹腔穿刺，抽出黄绿色液体，结合患者的表现，提示致病菌为大肠埃希菌（B对）。（P114）肺炎克雷伯菌肺炎亚种可引起重症肺炎、支气管炎，还能引起各种肺外感染，包括肠炎、婴幼儿脑膜炎、泌尿系统感染、创伤感染和败血症等（A错）。（P115）有的变形杆菌菌株尚可引起脑膜炎、腹膜炎、败血症和食物中毒等疾病，亦是医院感染的重要病原菌（C错）。（P162）铜绿假单胞菌也广泛分布在医院环境中，是引起医院感染的主要病原菌，其感染多见于皮肤黏膜破损部位，如烧伤、创伤或手术切口等。也见于因长期化疗或使用免疫抑制剂的病人，以及使用介入性临床诊疗措施时，表现为局部化脓性炎症。也可引起中耳炎、角膜炎、尿道炎、胃肠炎、心内膜炎和脓胸等（D错）。（P97）肠球菌 1.尿路感染。2.腹腔、盆腔感染。3.败血症。4.心内膜炎（E错）。